尿生殖三角
A. 后界为尾骨尖
B. 前界为两侧坐骨结节前缘的连线
C. 有肛管和尿道通过
D. 女性有尿道和阴道通过
E. 无

正确答案：D。女性有尿道和阴道通过

解析：后界为尾骨尖（A错）的是会阴；两侧坐骨结节的连线，将会阴分为前方的三角区尿生殖区和后方的三角区肛门区，所以尿生殖三角的后界为两侧坐骨结节前缘的连线（B错）；在肛门区有肛肠通过（C错），而尿生殖三角女性有尿道和阴道通过（D对）。